与2%二氯氧锆甲醇溶液生成黄色络合物的是
A. 二氢黄酮
B. 黄酮醇
C. 黄烷
D. 5-羟基黄烷
E. 4-羟基黄烷

正确答案：D。5-羟基黄烷

解析：本题考查的是黄酮类化合物的鉴别反应。与2%二氯氧锆甲醇溶液生成黄色络合物的是5-羟基黄烷（D对）。黄酮类化合物与锆盐反应：多用2%二氯氧化锆甲醇溶液。黄酮类化合物分子中有游离的3-羟基或5-羟基存在时，均可与该试剂反应生成黄色的锆络合物。